牙槽嵴部位有骨尖或骨突、骨嵴，在义齿在受力时造成疼痛的部位，一般不见于
A. 尖牙唇侧
B. 上下颌隆突
C. 内斜嵴
D. 上颌磨牙腭侧
E. 上颌结节颊侧

正确答案：D。上颌磨牙腭侧

解析：牙槽嵴部位有骨尖或骨突、骨嵴，形成组织倒凹，覆盖黏膜较薄，在摘戴义齿过程中擦伤黏膜组织或义齿在受力时造成疼痛。常见的部位有尖牙唇侧、上下颌隆突、上颌结节颊侧和内斜嵴等处。掌握“局部义齿修复后出现的问题及处理”知识点。